根据《医疗用毒性药品管理办法》，下列叙述正确的是
A. 采购的毒性中药材，包装材料上无须标上毒性药标志
B. 生产含有毒性药材的中成药时，须在本单位药品检验员的监督下准确投料
C. 科研和教学单位所需的毒性药品，凭本单位介绍信，在指定的供应部门购买
D. 医疗单位供应和调配毒性药品每次处方剂量不得超过三日极量
E. 擅自收购毒性药品，可处没收非法所得，并处以警告

正确答案：B。生产含有毒性药材的中成药时，须在本单位药品检验员的监督下准确投料

解析：本题考查《医疗用毒性药品管理办法》。根据《医疗用毒性药品管理办法》，下列叙述正确的是生产含有毒性药材的中成药时，须在本单位药品检验员的监督下准确投料（B对）。《医疗用毒性药品管理办法》第八条规定，生产毒性药品及其制剂，必须严格执行生产工艺操作规程，在本单位药品检验人员的监督下准确投料，并建立完整的生产记录，保存五年备查。毒性药品的包装容器上必须印有毒药标志（A错）。科研和教学单位所需的毒性药品，必须持本单位的证明信，经单位所在地县以上卫生行政部门批准后，供应部门方能发售（C错）。医疗单位供应和调配毒性药品，凭医生签名的正式处方。国营药店供应和调配毒性药品，凭盖有医生所在的医疗单位公章的正式处方。每次处方剂量不得超过二日极量（D错）。对违反本办法的规定，擅自生产、收购、经营毒性药品的单位或者个人，由县以上卫生行政部门没收其全部毒性药品，并处以警告或按非法所得的五至十倍罚款。情节严重、致人伤残或死亡，构成犯罪的，由司法机关依法追究其刑事责任（E错）。